《中国药典》规定，肿节风含量测定的指标成分是
A. 连翘苷
B. 七叶苷
C. 杜鹃素
D. 异嗪皮啶
E. 厚朴酚

正确答案：D。异嗪皮啶

解析：本题考查的是肿节风的含量测定成分。《中国药典》规定，肿节风含量测定的指标成分是异嗪皮啶（D对）和迷迭香酸。肿节风主要含有酚类、鞣质、黄酮苷、香豆素和内酯类化合物。《中国药典》采用高效液相色谱法测定药材中异嗪皮啶和迷迭香酸含量，其中异嗪皮啶含量不得少于0.020%，迷迭香酸含量不得少于0.020%。连翘苷（A错）为连翘的含量测定成分。连翘中的木脂素类成分多为双环氧木脂素及木脂内酯，《中国药典》以挥发油、连翘苷和连翘酯苷A为指标成分进行含量测定。要求青翘的挥发油含量不得少于2.0%（ml/g），青翘的连翘酯苷A含量不得少于3.5%，老翘含连翘酯苷A不得少于0.25%；对连翘苷含量要求不得少于0.15%。七叶苷（B错）为秦皮的含量测定成分。秦皮中主要含七叶内酯（秦皮乙素）和七叶苷（秦皮甲素），《中国药典》采用高效液相色谱法并规定本品按干燥品计，含秦皮甲素、秦皮乙素的总量不得少于1.0%。杜鹃素（C错）为满山红的含量测定成分。满山红中杜鹃素为祛痰成分，临床用于治疗慢性支气管炎。《中国药典》以杜鹃素为对照品对满山红进行含量测定。要求杜鹃素含量不少于0.08%。厚朴酚（E错）为厚朴的含量测定成分。厚朴中主要化学成分为木脂素类化合物，包括厚朴酚以及和厚朴酚等，《中国药典》采用高效液相色谱法测定厚朴酚与和厚朴酚含量，两者总含量不得少于2.0%。